参与特异性抗细胞内病原体感染的主要免疫效应细胞是
A. 巨噬细胞
B. Th2
C. CTL
D. B细胞
E. NK细胞

正确答案：C。CTL